降糖作用迅速，被称为“餐时血糖调节剂”的降糖药是
A. 瑞格列奈
B. 格列美脲
C. 二甲双胍
D. 普萘洛尔
E. 格列喹酮

正确答案：A。瑞格列奈

解析：本题考查降糖药的临床作用。瑞格列奈（A对）为非磺酰脲类促胰岛素分泌药，吸收快、起效快，既可降低空腹血糖，又可降低餐后血糖，无需餐前0.5h服用，因而又称为“餐时血糖调节剂”。格列美脲（B错）为磺酰脲类促胰岛素分泌药。二甲双胍（C错）首选用于单纯饮食控制及体育锻炼治疗无效的2型糖尿病。格列喹酮（E错）为磺酰脲类促胰岛素分泌药。普萘洛尔（D错）为心血管系统药，临床上不用做降糖药。